患者，男，25岁。头外伤后5分钟后清醒，送医院中再度昏迷。体检：浅昏迷，双侧瞳孔等大等圆，对光反射迟钝，左侧肢体肌力5级，巴宾斯基征阳性。若行CT检查，典型的表现是
A. 颅内无异常
B. 颅内散在点片状高密度影
C. 颅骨内板与颅表面间双凸形高密度影
D. 颅骨内板下新月形高密度影
E. 脑内圆形高密度影

正确答案：C。颅骨内板与颅表面间双凸形高密度影

解析：青年男性患者，头外伤（硬膜外血肿最多见于颞部、额顶部和颞顶部，患者多有头部受伤史）后5分钟后清醒，送医院中再度昏迷（原发性脑损伤轻时，伤后一般无原发性昏迷，待血肿形成后始出现意识障碍即为清醒→昏迷）。体检：浅昏迷，双侧瞳孔等大等圆，对光反射迟钝（早期动眼神经受到刺激，患侧瞳孔缩小，但时间短暂，往往不被察觉），左侧肢体肌力5级（正常肌力），巴宾斯基征阳性（提示存在锥体束损伤），综合患者的临床表现和体征可诊断为硬脑膜外血肿，其CT扫描表现为颅骨内板与硬脑膜之间的双凸镜形或弓形高密度影（C对）。脑震荡是最轻的脑损伤，其特点是伤后即发生短暂的意识障碍和近事遗忘，CT表现颅内无异常（A错）。脑挫裂伤患者CT表现为局部脑组织内有高低密度混杂影，点片状高密度影为出血灶（B错），低密度影为水肿区。硬脑膜下血肿患者CT显示脑表面新月形高密度（D错）、混杂密度或等密度影。脑内血肿患者CT扫描可证实脑内血肿的存在，表现为脑挫裂伤区附近或脑深部白质内类圆形（E错）或不规则高密度影。